《中国药典》规定，决明子含量测定的指标成分是
A. 大黄素和决明素
B. 大黄酸和决明内酯
C. 大黄酚和决明内酯
D. 大黄酚和橙黄决明素
E. 大黄酸和橙黄决明素

正确答案：D。大黄酚和橙黄决明素

解析：本题考查的是决明子的质量控制成分。《中国药典》规定，决明子含量测定的指标成分是是大黄酚和橙黄决明素（D对）。决明子中含有蒽醌类、萘并吡咯酮类、脂肪酸类等化学成分。其中，蒽醌类化合物为其主要成分，含量约1%，主要为大黄酚、大黄素甲醚、决明素、橙黄决明素、黄决明素、美决明素、葡萄糖美决明素、葡萄糖橙黄决明素。《中国药典》以大黄酚、橙黄决明素为指标成分进行含量测定，含量分别不得少于0.20%和0.80%。